2岁以下儿童用药可能会发生致死性肝损害，临床用药需要重点关注的抗癫痫药是
A. 丙戊酸钠
B. 苯妥英钠
C. 苯巴比妥
D. 氯硝西泮
E. 卡马西平

正确答案：A。丙戊酸钠

解析：本题考查药物的不良反应。2岁以下儿童用药可能会发生致死性肝损害，临床用药需要重点关注的抗癫痫药是丙戊酸钠（A对）。丙戊酸钠的不良反应：少见过敏性皮疹、血小板减少症或血小板凝聚抑制以致异常出血或瘀斑、肝脏中毒出现球结膜和皮肤黄染、胰腺炎、月经不规律及多囊卵巢、体重增加；三岁以下儿童使用本品发生肝损害的危险较大，致死性的肝功能障碍在2岁以下儿童多药治疗的发生率很高，临床用药需要重点关注。苯妥英钠（B错）的治疗窗较窄，临床应用注意监测血药浓度，常见不良反应有行为改变、笨拙或步态不稳、思维混乱、共济失调、眼球震颤、小脑前庭症状等。苯巴比妥（C错）常见的不良反应为宿醉现象，还可能出现致死性的剥脱性皮疹。氯硝西泮（D错）最常见的不良反应有嗜睡、共济失调及行为紊乱；有时可见焦虑、抑郁等精神症状。卡马西平（E错）的常见不良反应有视物模糊、复视、眼球震颤，少见变态反应、史蒂文斯-约翰综合征、红斑狼疮样综合征等。